成品须进行含醇量测定的有
A. 浸膏剂
B. 合剂
C. 酒剂
D. 流浸膏剂
E. 酊剂

正确答案：C、D、E。酒剂；流浸膏剂；酊剂

解析：本题考查的是须进行含醇量测定的剂型。成品须进行含醇量测定的有酒剂（C对）、流浸膏剂（D对）与酊剂（E对）。酒剂系指中药饮片用蒸馏酒提取制成的澄清液体制剂。酒剂的质量要求：酒剂中可加入适量的糖或蜂蜜调味。配制后的酒剂需静置澄清，滤过后分装于洁净的容器中，在贮存期间允许有少量摇之易散的沉淀。应检查乙醇含量和甲醇含量。除另有规定外，酒剂应密封，置阴凉处贮存。按照《中国药典》规定的方法检查，总固体、乙醇量、甲醇量、装量及微生物限度等均应符合有关规定。流浸膏剂、浸膏剂（A错）：系指饮片用适宜的溶剂提取，蒸去部分或全部溶剂，调整至规定浓度而制成的制剂。流浸膏剂与浸膏剂的质量要求：除另有规定外，流浸膏剂与浸膏剂应置遮光容器内密封，流浸膏剂应置阴凉处贮存。按照《中国药典》规定的方法检查，流浸膏剂、浸膏剂的装量、微生物限度应符合规定。含有乙醇的流浸膏剂的乙醇量、甲醇量应符合规定。除另有规定外，流浸膏剂要求每1ml相当于饮片1g。浸膏剂分为稠膏和干膏两种，每1g相当于饮片2～5g。酊剂：系指原料药物用规定浓度的乙醇提取或溶解而制成的澄清液体制剂，也可用流浸膏稀释制成。酊剂的质量要求：除另有规定外，普通中药酊剂每100ml相当于原饮片20g。含有毒性药品的中药酊剂，每100ml应相当于原饮片10g。除另有规定外，酊剂应遮光，密封，置阴凉处贮存。按照《中国药典》规定的方法检查，酊剂的甲醇量、乙醇量、装量及微生物限度等均应符合有关规定。合剂（B错）系指中药饮片用水或其他溶剂，采用适宜的方法提取、制成的口服液体制剂，其中单剂量灌装者也可称为口服液。合剂可以根据需要加入适宜的附加剂。如需加入抑菌剂，除另有规定外，在制剂确定处方时，该处方的抑菌效力应符合《中国药典》抑菌效力检查法的规定，山梨酸和苯甲酸的用量不得超过0.3%（其钾盐、钠盐的用量分别按酸计），羟苯酯类的用量不得超过0.05%，如加入其他附加剂，其品种与用量应符合国家标准的有关规定，不影响成品的稳定性，并应避免对检验产生干扰。必要时可加入适量的乙醇。合剂若加蔗糖，除另有规定外，含糖量一般不高于20%（g/ml）。除另有规定外，合剂应澄清。在贮存期间不得有发霉、酸败、异物、变色、产生气体或其他变质现象，允许有少量摇之易散的沉淀。pH、相对密度、装量及微生物限度应符合规定。除另有规定外，合剂应密封，置阴凉处贮存。